视交叉右外侧部断离可导致
A. 右眼颞侧视野缺失
B. 左眼颞侧视野缺失
C. 右眼鼻侧视野缺失
D. 两眼鼻侧视野缺失
E. 右眼对光反射消失

正确答案：C。右眼鼻侧视野缺失

解析：当视觉传导通路的不同部位受损时，可引起不同的视野缺损： 视网膜损伤引起的视野缺损与损伤的位置和范围有关； 一侧视神经损伤可致该侧眼视野全盲； 视交叉中交叉纤维损伤可致双眼视野颞侧半偏盲； 一侧视交叉外侧部的不交叉纤维损伤，则患侧眼视野的鼻侧半偏盲，所以视交叉右外侧部断离可导致右眼鼻侧视野缺失（C对）；一侧视束及以后的视觉传导路（视辐射、视区皮质）受损，可致双眼病灶对侧半视野同向性偏盲（如右侧受损则右眼视野鼻侧半和左眼视野颞侧半偏盲）。